下列除哪项外，均是舌颤动的病因
A. 气血两虚
B. 亡阳伤津
C. 热极生风
D. 酒毒所伤
E. 心脾有热

正确答案：E。心脾有热

解析：舌颤动为颤动舌的主要表现，主肝风内动，可因热盛、阳亢、阴亏、血虚等所致。心脾有热，为动风先兆，临床表现为吐弄舌（E对）。气血亏虚，致肝血不足，筋脉失养或血不荣筋，虚风内动，出现舌颤动（A错）。亡阳伤津为阳气和阴津的严重耗伤，可为气血亏虚重症，可致筋脉失养或血不荣筋，出现舌颤动（B错）。热极生风为火热之邪燔灼肝经，劫耗阴液，使筋脉拘挛或失于阴液的濡润，致肝风内动，出现舌颤动（C错）。酒毒内蕴，蕴而化热，热毒内炽，燔灼肝经致筋脉失养而致肝风内动或扰动心神，引动肝风，出现颤动舌（D错）。